乳衄的病因是
A. 心火旺
B. 肝火旺
C. 肺热上炎
D. 肾阴亏
E. 阴虚火旺

正确答案：B。肝火旺

解析：乳窍不时溢出少量血液，称为乳衄。足厥阴肝经上膈，布胸胁绕乳头而行，故乳房与肝经关系密切。肝气郁结，郁久化火，迫血妄行，或肝郁伤脾，肝脾不和，脾失统摄，血不循经都可致乳衄（B对）。心火旺、肺热上炎、肾阴亏、阴虚火旺皆不会出现乳衄（ACDE错）。